属塑化治疗适应证的是
A. 乳牙和年轻恒牙
B. 前牙
C. 根管细窄、弯曲，包括老年人的患病前牙
D. 准备进行桩核修复的患牙
E. 有根尖周囊肿的患牙

正确答案：C。根管细窄、弯曲，包括老年人的患病前牙

解析：本题考查塑化治疗的适应证。塑化治疗仅适用于：①成年人根尖部尚未破坏的后牙；②根管条件特殊的患牙根管细窄、弯曲，包括老年人的患病前牙（C对）。塑化治疗不适用于乳牙和年轻恒牙（A错）、根尖狭窄区已被破坏的患牙如有根尖周囊肿的患牙（E错），因为以上类型的牙齿根尖孔较大，塑化液从根尖孔渗出容易烧伤根尖周组织或引起急性根尖周炎等并发症。因为塑化液有颜色，一般为红色，时间久了颜色透出而影响美观，所以塑化治疗也不适用于前牙。一般做过塑化治疗之后的患牙根管很难打通，所以患牙在进行桩核修复之前（D错）不适用作塑化治疗，以免导致桩打入困难。